男，40岁。精神分裂症病史18年，第3次入院。入院后给予氟哌啶醇治疗，3天后加至30mg/d，第7天出现肌肉僵硬、震颤、吞咽困难，T39.8℃，意识不清，大汗淋漓，血清肌酸激酶增多。该患者首要的处理方法是
A. 换用非典型抗精神病药治疗
B. 盐酸苯海索治疗
C. 降温、抗感染
D. 立即给予电抽搐治疗
E. 即刻停用氟哌啶醇

正确答案：E。即刻停用氟哌啶醇

解析：该患者18年精神分裂症病史，第3次入院。入院后给予氟哌啶醇治疗，3天后加至30mg/d（药物加量过快，用量过高），第7天出现肌肉僵硬、震颤、高热，意识不清，大汗淋漓（自主神经功能紊乱），血清肌酸激酶增多，故最可能是恶性综合症。处理方法为即刻停用氟哌啶醇（抗精神病药物）（E对）。盐酸苯海索（安坦）主要用于治疗椎体外系反应中的类帕金森症（B错）。